直肠癌行保肛手术时，应重视保护直肠下段。此措施最主要的意义在于
A. 保留电解质吸收功能
B. 保留葡萄糖吸收功能
C. 保留黏液分泌功能
D. 保留水吸收功能
E. 保留正常排便反射

正确答案：E。保留正常排便反射

解析：直肠下段有肛直肠环，是括约肛管的重要结构，如手术时不慎完全切断，可引起大便失禁，保护直肠下段最主要的意义在于保留正常排便反射（E对）。保留电解质吸收功能（A错）、保留葡萄糖吸收功能（B错）、保留粘液分泌功能（C错）、保留水吸收功能（D错）均是保护直肠下段的意义，但其重要性尚不能与保留排便反射相比。